诊断冠心病的金标准是
A. 冠状动脉多排螺旋CT成像
B. 冠状动脉造影
C. 心电图
D. 超声多普勒
E. 手术病理

正确答案：B。冠状动脉造影

解析：诊断冠心病的金标准是冠状动脉造影（B对），因其可直接发现冠脉狭窄性病变的部位并估计其程度。冠状动脉多排螺旋CT成像（P231）（A错）可用于判断冠脉管腔狭窄程度和管壁钙化情况，有较高的阴性预测价值，但其对狭窄程度的判断仍有一定的限度，特别是当钙化存在时会显著影响判断。心电图（C错）一般分为常规心电图、动态心电图，可有心内膜下缺血征象，虽可辅助诊断冠心病，但其无法说明是何原因引起的冠脉缺血，也无法对冠脉的狭窄程度做出判断。超声多普勒（P231）（D错）在多数稳定型心绞痛静息时检查无异常，对冠心病的诊断意义不大。手术病理（E错）不是冠心病的辅助检查，其一般用于怀疑有恶变的疾病。